婴儿化脓性脑膜炎，怀疑有硬膜下积液，此时经济而可靠的检查方法是
A. X线
B. CT
C. MRI
D. 超声
E. 颅骨透照试验

正确答案：E。颅骨透照试验

解析：硬脑膜下积液（第七版诸福棠实用儿科学P916）有时积液量不多，颅透光试验却可以较早的检测出来，因此颅透光检查（E对）简便、无创，应为小婴儿化脓性脑膜炎怀疑合并硬膜下积液的首选诊断方法。颅透光检查呈阴性但仍疑有硬脑膜下积水的患儿可做颅脑超声（D错）检查和颅脑CT（B错）检查。颅脑MRI检查（C错）由于对硬脑膜下积液诊断的作用与效果和CT、B超类似，且价格昂贵，故不做首选。试验性硬膜下穿刺、腰穿脑脊液检查是用来确诊化脓性脑膜炎的有创检查，并非首选检查。颅脑疾病一般不做X线（A错）检查。